乙肝抗原抗体检查结果为：HBsAg（﹣），抗HBs（﹢），抗HBeIgG（﹢），HBeAg（﹣），抗HBe（﹢），应判断为
A. 乙肝病毒携带者
B. 乙肝急性期患者
C. 乙肝慢性期患者
D. 乙肝恢复期患者传染性弱
E. 乙肝恢复期患者传染性强

正确答案：D。乙肝恢复期患者传染性弱